饮用水深度净化的目的是
A. 去除水中的病原体
B. 去除水中的有机物
C. 去除水中的化学物质
D. 去除水中的低分子盐类
E. 获得优质饮用水

正确答案：E。获得优质饮用水

解析：本题考查深度净化的目的。饮用水深度净化是指在市政供水常规处理的基础上，再次对水质净化处理。旨在将常规处理工艺难以去除的有机污染物、重金属离子、消毒副产物的前驱体等加以去除。其目的是获得优质饮用水（E对ABCD错）。